下列哪种职业中毒会引起支气管哮喘
A. 二异氰酸甲苯酯
B. 聚乙烯
C. 聚氯乙烯
D. 含氟塑料

正确答案：A。二异氰酸甲苯酯

解析：本题考查会引起支气管哮喘的职业中毒。二异氰酸甲苯酯（A对BCD错），简称TDI，属低毒类，难经完整皮肤吸收，呼吸道是职业中毒的主要途径。其对皮肤黏膜有刺激作用，高浓度吸入可致化学性肺水肿；并具有致敏作用，多次接触可致过敏性皮炎和支气管哮喘。